在选择水源时，为了保证水质良好，要求只经过加氯消毒即供作生活饮用水的水源水，每100ml水样中总大肠菌群MPN值不超过
A. 20
B. 50
C. 100
D. 200
E. 2000

正确答案：D。200

解析：本题考查水源选择的相关内容。在选择水源时，为了保证水质良好，要求只经过加氯消毒即供作生活饮用水的水源水，每100ml水样中总大肠菌群MPN值不超过200（D对ABCE错）。